下列有关闭口运动的力说法正确的是
A. 牵引下颌向前上方运动
B. 颞肌、咬肌及翼内肌收缩
C. 稳定关节盘的作用
D. 翼外肌上头在髁突回位
E. 以上均正确

正确答案：E。以上均正确

解析：闭口运动的力：颞肌、咬肌及翼内肌的收缩，牵引下颌向前上方运动，使下颌回到牙尖交错位，翼外肌上头在髁突回位、关节盘向前旋转中起稳定关节盘的作用。掌握“下颌运动的形式、范围及意义”知识点。